因含有马来酸氯苯那敏，司机和登高作业者感冒时宜服用的中成药是
A. 强力感冒片
B. 金羚感冒片
C. 抗感灵片
D. 感冒清热颗粒
E. 舒肺糖浆

正确答案：B。金羚感冒片

解析：本题考查的是含西药组分的中成药。因含有马来酸氯苯那敏，司机和登高作业者感冒时宜服用的中成药是金羚感冒片（B对）。金羚感冒片：功能疏风解表，清热解毒。用于风热感冒，症见发热头痛、咽干口渴；上呼吸道感染见上述证候者。含西药成分：阿司匹林、马来酸氯苯那敏、维生素C。强力感冒片（A错）：功能疏风解表，清热解毒。用于风热感冒，症见发热、头痛、口干、咳嗽、咽喉痛。含西药成分：对乙酰氨基酚。抗感灵片（C错）：功能解热镇痛，消炎。用于感冒引起的鼻塞，流涕，咽部痒痛，咳嗽头痛，周身酸痛，发热及由感冒引起的扁桃体炎。含西药成分：对乙酰氨基酚。感冒清热颗粒（D错）的组成成分中不包括西药成分。舒肺糖浆（E错）：功能祛痰镇咳，用于急慢性支气管炎。含西药成分：盐酸麻黄碱、氯化铵。